食品生产经营人员必须进行健康检查的期限是
A. 2年
B. 1年
C. 6个月
D. 3个月
E. 18个月

正确答案：B。1年